现病史是指
A. 疾病诊治经过
B. 该次得病全部情况
C. 病人就诊的主要原因
D. 主要症状特点
E. 疾病原因与诱因

正确答案：B。该次得病全部情况

解析：现病史是指病史中最重要的部分，也是诊断疾病的主要依据，需详细询问及记录，就是该次得病全部情况（B对）。疾病诊治经过包括在现病史之内（A错）。病人就诊的主要原因时主诉（C错）。主要症状特点包括在现病史之内（D错）。疾病原因与诱因包括在现病史之内（E错）。